氯丙嗪抗精神病的作用机制是由于
A. 阻断肾上腺素α受体
B. 阻断M胆碱受体
C. 阻断中脑-边缘系统和中脑-皮层系统的D2样受体
D. 阻断延脑第四脑室底部的催吐化学感受区的D2受体
E. 阻断了黑质-纹状体通路的D2样受体

正确答案：C。阻断中脑-边缘系统和中脑-皮层系统的D2样受体

解析：氯丙嗪通过阻断中脑-边缘系统和中脑-皮层系统的D2样受体，对中枢神经系统有较强的抑制作用，也称神经安定作用。氯丙嗪能显著控制活动状态和躁狂状态而又不损伤感觉能力。掌握“氯丙嗪”知识点。